怎样才能采到真正反映水体情况的有代表性的水样
A. 在靠近岸边采集水样时，应注意从上游向下游采样
B. 采集表层水时，漂浮于水面上的物质对测定结果不会有影响
C. 采集水样时，采集量一定要准确达到分析测定所需的水样量
D. 采样时，将处理干净的适当容器充满即可
E. 在较浅的小河采集水样时，要注意避免搅动沉积物而使水样受污染

正确答案：E。在较浅的小河采集水样时，要注意避免搅动沉积物而使水样受污染

解析：本题考查反映水体情况的有代表性的水样。在采集水样时，要注意避免搅动沉积物而使水样受污染（E对ABCD错），因为沉积物是水体中的有机和无机物质，它们可以吸收和蓄积污染物质，并在搅动后释放出来，从而使采集水样不能反映水体实际情况。此外，在采集水样时，还应注意从上游向下游采样，采集表层水，采集量要准确达到分析测定所需的水样量，并使用处理干净的适当容器充满，以确保采集水样的真实性。在此基础上，才能采集到真正反映水体情况的有代表性的水样。